以苯二氮䓬受体为作用靶点的药物有
A. 地西泮
B. 奥沙西泮
C. 阿普唑仑
D. 艾司唑仑
E. 卡马西平

正确答案：A、B、C、D。地西泮；奥沙西泮；阿普唑仑；艾司唑仑

解析：本题考查苯二氮䓬类药物。地西泮（A对）、奥沙西泮（B对）、阿普唑仑（C对）、艾司唑仑（D对）均为苯二氮䓬类镇静催眠药，苯二氮䓬类药物作用于大脑皮质、边缘系统、中脑、脑干和脊髓，与γ-氨基丁酸（GABA）受体复合物上的苯二氮䓬受体结合并激动该受体，促进GABA与GABA受体结合，使Cl⁻通道开放频率增加，Cl⁻内流增多，导致细胞膜超极化，呈现中枢抑制作用。卡马西平（E错）为二苯并氮䓬类药物，作用于电压依赖性的钠通道，不作用于苯二氮䓬受体。